在延髓交叉的纤维，不包括
A. 薄束核和楔束核发出的纤维
B. 三叉神经脊束核发出的纤维核
C. 皮质脊髓束的大部分纤维
D. 后角固有核发出的纤维核
E. 下橄榄核发出至小脑的纤维

正确答案：D。后角固有核发出的纤维核

解析：薄束核和楔束核（A对）、三叉神经脊束核（B对）、皮质脊髓束（C对）、下橄榄核（E对）发出至小脑的纤维均在延髓交叉，后角固有核（第Ⅰ、Ⅳ到Ⅶ层）（D错，为本题正确选项）发出纤维经脊髓上升1-2个节段经白质前连合交叉到对侧，不在延髓交叉。